铅、锰、镉、砷、铊通过生物膜的方式
A. 简单扩散
B. 滤过
C. 主动转运
D. 载体扩散
E. 胞饮和吞噬

正确答案：C。主动转运

解析：本题考查化学毒物通过生物膜的方式。主动转运是指化学毒物在载体的参与下，逆浓度梯度通过生物膜的过程。铅、锰、镉、砷、铊通过生物膜的方式为主动转运（C对ABDE错）。